通式为RNH⁺X⁻的阳离子表面活性剂是
A. 硬脂酸钠
B. 苯扎溴铵
C. 卵磷脂
D. 聚乙烯醇
E. 聚山梨酯80

正确答案：B。苯扎溴铵

解析：本题考查表面活性剂。苯扎溴铵（B对）属于阳离子表面活性剂；硬脂酸钠（A错）为阴离子表面活性剂；卵磷脂（C错）为两性离子表面活性剂；聚乙烯醇（D错）为高分子表面活性剂；聚山梨脂80（E错）为非离子表面活性剂。